有中枢作用的H₁受体阻断药是
A. 阿司咪唑
B. 西替利嗪
C. 苯海拉明
D. 吡咯醇胺
E. 赛庚啶

正确答案：C。苯海拉明

解析：本题考查氨基糖苷类的作用机制。氨基糖苷类药物通过抑制蛋白质合成（D对）发挥抗菌作用。氨基糖苷类能与细菌的30S核糖体结合，影响蛋白质合成过程的多个环节，还可影响细菌细胞膜屏障功能。磺胺的抗菌机制是影响叶酸代谢（A错）。通过影响胞浆膜通透性（B错）而发挥抗菌作用的药物是多黏菌素、制霉菌素、两性霉素B等。β-内酰胺酶类的抗菌机制是抑制细菌细胞壁的合成（C错）。喹诺酮类抗生素的作用机制是抑制核酸合成（E错）。